下列非处方药中，使用期间不得饮酒的有
A. 布洛芬
B. 阿司匹林
C. 葡萄糖酸钙
D. 对乙酰氨基酚
E. 谷维素

正确答案：A、B、D。布洛芬；阿司匹林；对乙酰氨基酚

解析：本题考查使用期间不宜饮酒的药物。布洛芬（A对）、阿司匹林（B对）和对乙酰氨基酚（D对）是非甾体抗炎药，与乙醇合用会增加对消化道的刺激性，同时也会增加肝肾的毒性。葡萄糖酸钙（C错）和谷维素（E错）与酒精共同服用影响不大。